同病异治的实质是
A. 证同治异
B. 证异治异
C. 病同治异
D. 证异治同
E. 病同治同

正确答案：B。证异治异

解析：本题考查同病异治的实质，属于理解记忆内容。同病异治，指同一种病，由于发病的时间、地域不同，或所处的疾病的阶段或类型不同，或病人的体质有异，故反映出的证候不同（Ａ错），因而治疗也就有异（DE错）表面上是同一种病而治疗方法不同（C错），实质上是同一种病的不同证候需要的治疗也不同（B对）。